膀胱原位癌的病变范围
A. 达膀胱深层肌
B. 达膀胱浅层肌
C. 侵犯膀胱壁外组织
D. 限于固有层以内
E. 位于膀胱黏膜层内

正确答案：E。位于膀胱黏膜层内

解析：膀胱原位癌局限在黏膜内（E对）（P567），可参考膀胱癌2009TNM分期（P568表53-1），达膀胱深层肌（A错）的为分期为T2b；达膀胱浅层肌（B错）的分期为T2a；侵犯膀胱壁外组织（C错）的分期为T3；限于固有层以内（D错）的分期为T1。